以下是对健康促进学校的理解，不正确的是
A. 是健康促进理论在学校场所的具体运用
B. 健康促进学校关注学生身体、心理和社会适应能力的全面提高
C. 健康促进学校需要调动多方有利于学生成长的资源
D. 动员政府参与是开展健康促进学校工作最重要的措施
E. 资源不足、条件差的学校没有开展健康促进学校的条件

正确答案：E。资源不足、条件差的学校没有开展健康促进学校的条件